无眩晕、无听力障碍和肌力完好的患者，出现右上肢指鼻试验不正确和轮替动作差、右下肢跟膝胫试验差。病损部位在
A. 小脑蚓部
B. 右侧小脑半球
C. 左侧小脑半球
D. 左侧脑桥前庭神经核
E. 右侧脑桥前庭神经核

正确答案：B。右侧小脑半球

解析：小脑主要维持躯体平衡，控制姿势和步态，调节肌张力和协调随意运动的精准性。小脑的传出纤维在传导过程中有两次交叉，对躯体活动发挥同侧协调作用，并有躯体各部位的代表区，如小脑半球的代表区，其上半部分代表上肢，下半部分代表下肢，蚓部则是躯干代表区。右上肢指鼻试验不正确和轮替动作差、右下肢跟膝胫试验差等同侧肢体的共济失调可将病灶定位于小脑右半球病变（B对C错）。小脑蚓部（A错）病损则出现躯干的共济失调（P19），主要表现为表现为躯干不能保持直立姿势，站立不稳、向前或向后倾倒及闭目难立征。脑桥前庭神经核（DE错）受损虽然也会出现共济失调，但会伴有眩晕、恶心、呕吐、眼球震颤表现（P42）。